平行试验可以提高诊断试验的
A. 阳性预测值
B. 阴性预测值
C. 灵敏度
D. 特异度

正确答案：C。灵敏度

解析：本题考查平行试验的优点。平行试验，也叫并联试验，即全部筛检试验同时平行开展，任何一项筛检试验结果阳性就可判定为阳性。该方法的优点是可以提高筛查整体的灵敏度（C对ABD错），但会降低特异度。